以下不属于有机磷酸酯类农药中毒的M样症状的是
A. 腹痛
B. 瞳孔扩大
C. 瞳孔缩小
D. 呼吸困难
E. 唾液分泌增多

正确答案：B。瞳孔扩大

解析：急性有机磷酸酯类中毒主要表现为对胆碱能神经突触、胆碱能神经肌肉接头和中枢神经系统的影响，应为瞳孔缩小。掌握“难逆性抗胆碱酯酶药及胆碱酯酶复活药”知识点。